需要与创伤性溃疡相鉴别的疾病有
A. 口腔黏膜外伤、残冠、口腔癌
B. 残冠、不良修复体、结核性溃疡
C. 口腔癌、腺周口疮、结核性溃疡
D. 疱疹性龈口炎、天疱疮、腺周口疮
E. 球菌性口炎、结核性溃疡、艾滋病

正确答案：C。口腔癌、腺周口疮、结核性溃疡

解析：本题考查创伤性溃疡。创伤性溃疡物理性损伤是比较容易诊断的，因为无论是急性或慢性，均可从患者的主诉及病损的局部找到相对应的刺激物，但需与口腔癌、腺周口疮、结核性溃疡鉴别（C对）。